延胡索的产地加工是
A. 直接晒干
B. 发汗后晒干
C. 煮至恰无白心后晒干
D. 蒸透后晒干
E. 去外皮后晒干

正确答案：C。煮至恰无白心后晒干

解析：本题考查的是延胡索的采收加工。延胡索的产地加工是煮至恰无白心后晒干（C对）。延胡索：【采收加工】夏初茎叶枯萎时采挖，除去须根，洗净，置沸水中煮至恰无白心时，取出，晒干。直接晒干（A错）的药材有绵马贯众、虎杖、何首乌、赤芍、板蓝根等。发汗后晒干（B错）的药材有秦艽、玄参、续断、厚朴、杜仲、茯苓等。蒸透后晒干（D错）的药材有香附、玉竹、黄精、莪术等。去外皮后晒干（E错）的药材有粉葛、天花粉、桔梗、三棱、知母等。